单侧多根多处肋骨骨折最严重的生理改变是
A. 疼痛，呼吸运动减弱
B. 胸壁软化，反常呼吸
C. 咳嗽，血痰
D. 严重皮下气肿
E. 出血，休克

正确答案：B。胸壁软化，反常呼吸

解析：单侧多根多处肋骨骨折最严重的生理改变是胸壁软化，反常呼吸（B对）。多根多处肋骨骨折使局部胸壁失去完整肋骨支撑而软化，从而出现反常呼吸运动，即吸气时软化区胸壁内陷，呼气时外突。疼痛，呼吸运动减弱（A错），咳嗽，血痰（C错），严重皮下气肿（D错），出血，休克（E错）都是肋骨骨折的临床表现。